对解剖复位要求最高的骨折是
A. 胫骨平台骨折
B. 肱骨干骨折
C. 腓骨中段骨折
D. 锁骨骨折
E. 掌骨骨折

正确答案：A。胫骨平台骨折

解析：骨折端通过复位，恢复了正常解剖关系，对位和对线完全良好时，称解剖复位。经复位后，两骨折端虽未恢复至正常解剖关系，但在骨折愈合后对肢体功能无明显影响者，称功能复位（P621）。胫骨平台是膝关节的重要负荷结构，内外侧分别有内、外侧副韧带附着，当胫骨平台骨折（A对）时，常发生韧带及半月板损伤，移位的胫骨平台骨折为不稳定的关节内骨折，骨折后复位不良，使内、外平台受力不均，将产生骨关节炎改变，所以必须坚持解剖复位（P671、P672）。肱骨干骨折（B错）若无神经、血管受损等严重损伤，可行手法复位外固定治疗，肱骨干稍有畸形，对功能影响不大，不需解剖复位（P633）。单纯腓骨中段（C错）骨折，若不伴有上下胫腓联合分离，亦不需特殊治疗，不需解剖复位（P675）。锁骨骨折（D错）多发生在儿童及青壮年，儿童青枝骨折及成人的无移位骨折可不作特殊治疗，仅用三角巾悬吊，对有移位的锁骨中段骨折，手法复位满意的，可采用横形“8”字绷带固定，不要求解剖复位（P629）。掌骨骨折（E错）治疗的最终目的是恢复手的运动功能，对开放性骨折脱位，需立即复位同时修复撕裂的关节囊、韧带，但闭合无明显移位的骨折或经复位较稳定的骨折非手术治疗即可，不要求解剖复位（P647）。